天南星的性能特点有
A. 甘润苦降
B. 善祛脾胃湿痰
C. 苦燥辛散
D. 温化有毒
E. 善祛经络风痰

正确答案：C、D、E。苦燥辛散；温化有毒；善祛经络风痰

解析：本题考查的是天南星的性能特点。天南星的性能特点有苦燥辛散（C对）、温化有毒（D对）、善祛经络风痰（E对）。天南星：【性能特点】本品苦燥辛散，温化有毒，药力较强，入肺、肝、脾经。内服既燥湿化痰，治顽痰咳嗽；又祛风止痉，治风痰诸证及破伤风。湿痰、风痰皆宜，兼寒者尤佳，兼热者当配苦寒之品。生者外用攻毒、散结、消肿而止痛，治痈疽、瘰疬。功似半夏而力强，尤善祛经络风痰而止痉。治脾胃湿痰（B错），以半夏为主天南星辅之；治经络风痰，以天南星为主半夏辅之。百部：【性能特点】本品甘润苦降（A错），性平不偏，专入肺经。善润肺止咳，为治新久咳嗽之要药，最宜痨嗽及百日咳。善杀虫灭虱，为治头虱、体虱、蛲虫病之佳品。